与青霉素相比，阿莫西林
A. 对G+细菌的抗菌作用强
B. 对G+杆菌作用强
C. 对β-内酰胺酶稳定
D. 对耐药金葡菌有效
E. 对绿脓杆菌有效

正确答案：B。对G+杆菌作用强